患者，男，65岁，咳喘20年，动则喘甚，呼多吸少，气不得续，形瘦神疲，汗出肢冷面青唇紫，舌淡苔白，脉微细，治疗应首选的方剂是
A. 济生肾气丸和生脉散
B. 七味都气丸合参附汤
C. 金匮肾气丸合参蛤散
D. 参附汤合黑锡丹
E. 苏子降气汤合四逆汤

正确答案：C。金匮肾气丸合参蛤散

解析：患者为喘证。喘证分实喘和虚喘，不难判断此病人为虚喘证。虚喘分为肺气虚耗证、肾虚不纳证、正虚喘脱证。肺气虚耗证以肺气虚为主；肾虚不纳证肺病及肾，肾气不纳，动则喘甚，呼多吸少，气不得续，此证以阳气虚为多见，用金匮肾气丸合参蛤散（C对）加减，若肾阴虚者，不宜辛燥，宜用七味都气丸合生脉散(B错)加减；正虚喘脱证喘促较重，咳喘欲绝，汗出肢冷，脉浮大无根等，为元气大亏，有亡阴、亡阳之危，用参附汤送服黑锡丹（D错），配合蛤蚧粉。济生肾气丸补肾利水（A错），苏子降气汤治上盛下虚之喘咳（E错）。